牙本质中龋时牙髓受刺激后可造成
A. 继发性牙本质形成
B. 修复性牙本质形成
C. 牙髓充血
D. 牙髓变性
E. 牙髓钙变

正确答案：B。修复性牙本质形成

解析：本题考查中龋。中龋时牙髓组织受到刺激，可形成修复性牙本质（B对）。继发性牙本质是牙根发育完成、牙与咬合牙建立咬合关系后形成的牙本质，是生理状态下发生的（A错）。深龋时牙髓组织受到刺激可引起牙髓充血（C错）。当牙髓血供不足时，可造成牙髓组织营养不良，长时间可使牙髓细胞变性坏死（D错），或钙盐沉积形成钙化物（E错）。